一位女医生声调柔和，目光亲切，讲话面带微笑，她在下列哪方面做得好
A. 言语沟通
B. 非言语沟通
C. 言语沟通和非言语沟通
D. 目光沟通
E. 以上都不是

正确答案：B。非言语沟通